个体自我意识发展的开始时期是
A. 胎儿期
B. 婴儿期
C. 幼儿期
D. 学龄期
E. 青春期

正确答案：C。幼儿期

解析：从怀孕到出生为胎儿期，0～1岁为婴儿期，1～3岁为婴幼儿期，3～6岁为幼儿期，6～12岁为儿童期（也称学龄期），12～18岁为青春期。3～6岁称幼儿期。在幼儿期，神经纤维髓鞘已基本形成，神经兴奋性逐渐增高，睡眠时间相对减少，条件反射比较稳定。语言进一步发展，掌握词汇量增多，大脑的控制、调节功能逐渐发展。个性初步形成，自我意识开始发展（C对），3岁左右开始出现自主行为，表现不听话，对事物的评价常带有极大的主观性。开始发展性别认同，已能区分男孩、女孩。认知特点有自我中心、万物有灵论、符号功能。感知觉迅速发展，能有意识地进行感知和观察，但不持久，容易转移。记忆带有直观形象性和无意性。幼儿的情感强烈、易变，容易受外界事物感染。意志行为也有进一步发展，活动的目的性、独立性逐步增长，能使自己行动服从成人或集体的要求。但自觉性、自制力仍较差。